可用于单纯疱疹病毒性角膜炎治疗的药物是
A. 利福平
B. 卡替洛尔
C. 左氧氟沙星
D. 阿托品
E. 利巴韦林

正确答案：E。利巴韦林

解析：本题考查药物的适应证。利巴韦林（E对）为抗眼部病毒感染药，用于单纯疱疹病毒性角膜炎。利福平（A错）、左氧氟沙星（C错）为抗眼部细菌感染药。卡替洛尔（B错）为降低眼压的药物。阿托品（D错）为抗M胆碱类散瞳剂。